硝苯地平对心肌的作用除外的是
A. 对心肌具有负性肌力作用
B. 对心肌具有负性传导作用
C. 明显增加心肌收缩性
D. 起负性传导作用时传导速度由Ca2+决定
E. 心肌兴奋收缩脱耦联，降低心肌耗氧量

正确答案：C。明显增加心肌收缩性

解析：对心肌的作用：①负性肌力作用：钙通道阻滞药可在不影响兴奋除极的情况下，明显降低心肌收缩性，使心肌兴奋收缩脱耦联，降低心肌耗氧量。②负性频率和负性传导作用：窦房结和房室结等慢反应细胞的传导速度和自律性由Ca2+内流所决定，因而钙通道阻滞药能减慢房室结的传导速度，降低窦房结自律性，而减慢心率。掌握“钙通道阻滞药药理作用和不良反应”知识点。